肾外原因引起的低容量性低钠血症早期
A. 尿量减少，尿钠含量降低
B. 尿量减少，尿钠含量增加
C. 尿量不少，尿钠含量降低
D. 尿量增多，尿钠含量降低
E. 尿量增多，尿钠含量增加

正确答案：A。尿量减少，尿钠含量降低

解析：低渗性脱水时机体循环血量减少导致尿量减少，醛固酮分泌增加时钠的重吸收增加，尿钠含量降低（A对）。尿量减少，尿钠含量增加（B错）见于肾性原因引起的低容量性低钠血症。